现代流行病学的内容包括
A. 传染性疾病
B. 非传染性疾病
C. 两者均是
D. 两者均否

正确答案：C。两者均是

解析：本题考查流行病学的内容。流行病学的研究内容包括了疾病、伤害和健康三个层次。疾病包括传染病、寄生虫病、地方病和非传染性疾病（C对ABD错）等所有疾病。伤害包括意外、残疾、智障和身心损害等。健康是指身体、精神和社会适应各方面均处于完好状态，而不只是无病或虚弱。